上颌前牙缺失后，舌齿音发音受阻，属于
A. 美观的影响
B. 咀嚼功能减退
C. 发音功能障碍
D. 颞下颌关节病变
E. 对牙周组织的影响

正确答案：C。发音功能障碍

解析：牙列缺损导致的发音功能障碍：前牙缺失对发音功能影响很大，特别是影响齿音、唇齿音、舌齿音的发音，从而影响讲话时的清晰度。掌握“牙列缺损病因及影响”知识点。